单室模型静脉滴注给药过程中，稳定血药浓度的计算公式是
A. MRT=AUMC/AUC
B. Css=K₀/KV
C. fss=1-e-kt
D. C=K₀（1-e-kt）/KV
E. E=dXu/dt=ke·X₀e-kt

正确答案：B。Css=K₀/KV

解析：本题考查单室模型静脉滴注给药。静脉滴注开始的一段时间内，血药浓度逐渐上升，然后趋于恒定水平，此时的血药浓度值称为稳态血药浓度或坪浓度，用Css表示，Css=K₀/KV（B对）；药物在体内的平均滞留时间即一阶矩，可以用下式定义：MRT=AUMC/AUC（A错）； 达坪分数fss=1-e-kt（C错）；C=K₀（1-e-kt）/KV（D错）为单室模型静脉滴注给药，血药浓度C与时间t的关系式；E=dXu/dt＝ke·X₀e-kt（E错）为尿排泄速度与时间的关系公式。